老年人脂肪供能应占膳食总能量的
A. 10%～20%
B. 15%～25%
C. 20%～35%
D. 20%～30%
E. 25%～35%

正确答案：D。20%～30%

解析：本题考查老年人脂肪供能应占膳食总能量的百分比。由于老年人胆汁分泌减少和酯酶活性降低而对脂肪的消化功能下降，因此，脂肪的摄入不宜过多，脂肪供能占膳食总能量的20%～30%（D对ABCE错）为宜。